关于中药饮片生产经营管理的说法，正确的是
A. 药品批发企业中药饮片采购人员应当具有中药学中级以上专业技术职称
B. 生产中药饮片必须在符合药品生产质量管理规范条件下组织生产，出厂应经检验合格
C. 批发企业可以从中药材专业市场购进中药材初加工产品，直接套袋按中药饮片销售
D. 药品零售企业的中药饮片调剂人员必须为中药调剂员

正确答案：B。生产中药饮片必须在符合药品生产质量管理规范条件下组织生产，出厂应经检验合格

解析：本题考查中药饮片生产管理。关于中药饮片生产经营管理的说法，正确的是生产中药饮片必须在符合药品生产质量管理规范条件下组织生产，出厂应经检验合格（B对）。生产中药饮片必须持有《药品生产许可证》，应当遵守药品生产质量管理规范；必须以中药材为起始原料，使用符合药用标准的中药材（购进未实施审批管理的中药材除外），并应尽量固定药材产地；必须严格执行国家药品标准和地方中药饮片炮制规范、工艺规程；必须在符合药品GMP条件下组织生产，出厂的中药饮片应检验合格，并随货附纸质或电子版的检验报告书。中药饮片应当按照国家药品标准炮制；国家药品标准没有规定的，应当按照省、自治区、直辖市人民政府药品监督管理部门制定的炮制规范炮制。省、自治区、直辖市人民政府药品监督管理部门制定的炮制规范应当报国务院药品监督管理部门备案。不符合国家药品标准或者不按照省、自治区、直辖市人民政府药品监督管理部门制定的炮制规范炮制的，不得出厂、销售。药品批发企业中从事中药材、中药饮片验收工作的，应当具有中药学专业中专以上学历或者具有中药学中级以上专业技术职称（A错）。药品批发企业不得以中药材及初加工产品冒充中药饮片销售（C错），非法加工中药饮片。药品零售企业从事中药饮片调剂人员应当具有中药学中专以上学历或者具备中药调剂员资格（D错）。